⊥III表示
A. 右上颌第l乳磨牙
B. 右上颌第2乳磨牙
C. 右上颌乳尖牙
D. 左上颌乳尖牙
E. 左上颌第1乳磨

正确答案：D。左上颌乳尖牙

解析：Ⅲ表示乳尖牙，⊥Ⅲ表示在右上象限即左上颌，故⊥Ⅲ为左上颌乳尖牙(D对)。